男，38岁。车祸致胸部损伤，出现严重呼吸困难，查体：BP80/60mmHg，脉细速，皮肤完整，气管左移，颈静脉充盈，颈部及右胸部皮下气肿，右胸饱满，肋间隙增宽，叩鼓音，右肺呼吸音消失。其主要的病理生理紊乱为
A. 静脉回心血量增加
B. 纵隔扑动
C. 患侧胸膜腔正压
D. 每分通气量增加
E. 急性肺水肿

正确答案：C。患侧胸膜腔正压

解析：青年男性患者，车祸致胸部损伤后，出现严重呼吸困难（提示有肺部损伤），查体见气管左移，颈静脉充盈，颈部及右胸部皮下气肿，右胸饱满，肋间隙增宽，叩诊呈鼓音，右肺呼吸音消失，提示可能为气胸且症状较重。BP80/60mmHg（正常值为90～140/60～90mmHg，提示有循环功能障碍），皮肤完整（提示为非开放性损伤），结合患者病史、症状和体征，最可能的诊断为右侧张力性气胸。张力性气胸破裂口呈单向活瓣或活塞作用，吸气时胸廓扩大，胸膜腔内压变小，空气进入胸膜腔；呼气时胸膜腔内压升高，压迫活瓣使之关闭，致使胸膜腔内空气越积越多，内压持续升高，胸膜腔内压测定常超过10cmH₂O，甚至高达20cmH₂O，使肺脏受压，纵隔向健侧移位，影响心脏血液回流，故该患者主要病理生理紊乱为患侧胸膜腔正压（C对）。伤侧肺严重萎陷，纵隔向健侧移位，使得静脉回心血量减少（A错）、每分通气量降低（D错）。纵隔扑动（B错）为开放性气胸、和闭合性多根多处肋骨骨折的表现。急性肺水肿（E错）为急性左心衰的主要表现。